有关骨半规管的描述，错误的是
A. 是三个“c”字形互成直角排列的弯曲小管
B. 外半规管又称水平半规管
C. 每个半规管均有单骨脚和壶腹骨脚
D. 三个半规管共有六个孔与前庭相通
E. 以上均不对

正确答案：D。三个半规管共有六个孔与前庭相通

解析：骨半规管为3个半环形的骨管，相互垂直排列（A对）。外骨半规管弓向外侧，当头前倾30°角时，呈水平位，又称水平半规管（B对）。每个骨半规管皆有两个骨脚连于前庭，其中一个骨脚膨大称壶腹骨脚，另一骨脚细小称单骨脚（C对）。因前、后半规管的单骨脚合成一个总骨脚，故3个骨半规管共有5个口连于前庭（D错，为本题正确答案）。